对于高度房室传导阻滞或窦房结功能衰竭而并发的心脏骤停，异丙肾上腺素常与哪种药物合用作心室内注射
A. 酚妥拉明
B. 利多卡因
C. 间羟胺
D. 阿托品
E. 乙酰胆碱

正确答案：C。间羟胺

解析：异丙肾上腺素常与去甲肾上腺素或间羟胺合用作心室内注射，适用于高度房室传导阻滞或窦房结功能衰竭而并发的心脏骤停。掌握“多巴胺和异丙肾上腺素”知识点。